肺结核原发综合征的典型临床表现
A. 病灶常为多结节性
B. 原发灶、淋巴管炎及肺门淋巴结结核
C. 肺内可有一个或多个空洞
D. 病灶位于锁骨上、下
E. 肺内常见结核球

正确答案：B。原发灶、淋巴管炎及肺门淋巴结结核

解析：原发型肺结核时，肺部原发病灶、淋巴管炎和肺门淋巴结结核称为原发综合征（B对），X线呈哑铃状阴影，临床上症状和体征多不明显。多结节性病灶（A错）常见于继发性肺结核。肺结核原发综合征肺内原发病灶一般吸收较快，可不留任何痕迹，所以很少形成空洞（C错）。肺结核原发综合征好发于通气较好的肺上叶下部和下叶上部，病灶位于锁骨上、下（D错）为继发型肺结核的好发部位。结核球（E错）多由干酪样病变吸收和周边纤维膜包裹或干酪空洞阻塞性愈合而形成，见于继发型肺结核。